下列各项，不属于风湿性心脏瓣膜病中医病因的是
A. 正气虚弱
B. 外邪侵袭
C. 心血瘀阻
D. 心肺气虚
E. 湿热毒邪

正确答案：D。心肺气虚

解析：风心病主要因为外邪袭侵（B对），湿热毒邪（E对）等侵及人体，久留不去或反复侵袭，由表入里，内设于心阻痹经气，久之损伤心气脉络，心血瘀阻（C对）。或因先天不足、年老体虚等正气虚弱（A对），影响及心，致心气衰弱，气不行血，致气虚血瘀，或损及心阳、心阴，气血衰败，发为此病。心肺气虚（D错，为本题正确答案）不属于风湿性心脏瓣膜病中医病因。